巴戟天除补肾阳、强筋骨外，又能
A. 滋肾阴
B. 补脾气
C. 祛风湿
D. 纳肾气
E. 祛痰湿

正确答案：C。祛风湿

解析：本题考查的是巴戟天的功效。巴戟天除补肾阳、强筋骨外，又能祛风湿（C对）。巴戟天：【功效】补肾阳，强筋骨，祛风湿。知母：【功效】清热泻火，滋阴（A错）润燥。人参：【功效】大补元气，补脾益肺，生津止渴，安神益智。人参性微温，补气力甚强，气虚、气阴两虚之重症、急症多用；又善补脾气（B错）、益肺气，为治脾肺气虚证所常用。沉香：【功效】行气止痛，温中止呕，温肾纳气（D错）。雄黄：【功效】解毒，杀虫，燥湿祛痰（E错），截疟定惊。